某网站以发布“促进女性排卵，帮助生双胞胎”倍息等方式推广销售处方药枸橼酸氯米芬片。关于本事件相关法律问题的说法，正确的有
A. 网站不能在网上向个人消费者销售处方药
B. 网站涉及以虚假信息非法销售处方药的违法活动
C. 公众应凭医师处方通过正规渠道购买该处方药
D. 对这类处方药，患者应在医师指导下正确使用
E. 网站应经药品广告审批部门批淮后才能在网站上推广该处方药

正确答案：A、B、C、D。网站不能在网上向个人消费者销售处方药；网站涉及以虚假信息非法销售处方药的违法活动；公众应凭医师处方通过正规渠道购买该处方药；对这类处方药，患者应在医师指导下正确使用

解析：本题考查药品广告法。药品枸橼酸氯米芬片是处方药，不得在大众传播媒介发布广告（A对），也不能在网上向个人消费者销售。该药适应证为不孕不育，并非其所声称的能生双胞胎，涉及以虚假信息非法销售处方药（B对）。滥用药物会危害身体健康，公众应凭处方通过正规渠道购买该处方药（C对），并在医生指导下使用（D对）。